属于化脓性炎症的是
A. 嗜酸性脓肿
B. 阿米巴肝脓肿
C. 冷脓肿
D. 转移性脓肿
E. 炎性肉芽肿

正确答案：D。转移性脓肿

解析：化脓性炎症是以中性粒细胞渗出，且伴有不同程度的组织坏死和脓液形成为特点的炎症，包括表面化脓和积脓、蜂窝织炎和脓肿。转移性脓肿（D对）是指由化脓菌引起，并随血液迁移至全身多器官的脓肿，属于化脓性炎症。嗜酸性脓肿（P373）（A错）是指急性虫卵结节中，由大量嗜酸性粒细胞浸润形成的脓肿状病灶，并非真正的脓肿。阿米巴肝脓肿（B错）是溶组织阿米巴滋养体在肝内发生坏死而形成的。冷脓肿（P357）（C错）是指由结核杆菌引起的干酪样坏死物液化后形成的脓肿样病灶，常见于骨结核中。炎性肉芽肿（P78）（E错）是指炎症局部巨噬细胞及其衍生细胞增生形成的境界清楚的结节状病灶。
1、转移性脓肿:由化脓菌引起，并随血液迁移至全身多器官的脓肿，属于化脓性炎症。 2、嗜酸性脓肿（P373）是指急性虫卵结节中，由大量嗜酸性粒细胞浸润形成的脓肿状病灶，并非真正的脓肿。 3、阿米巴肝脓肿:溶组织阿米巴滋养体在肝内发生坏死而形成的。变质性炎。 4、冷脓肿（P357)指由结核杆菌引起的干酪样坏死物液化后形成的脓肿样病灶，常见于骨结核中。 5、炎性肉芽肿（P78）指炎症局部巨噬细胞及其衍生细胞增生形成的境界清楚的结节状病灶。